慢性乙型肝炎最重要的治疗是
A. 免疫调节治疗
B. 保肝治疗
C. 抗病毒治疗
D. 中医中药治疗
E. 抗纤维化治疗

正确答案：C。抗病毒治疗

解析：慢性肝病患者应根据具体情况采用综合性治疗方案，包括合理的休息和营养、改善和恢复肝功能、调节机体免疫、抗病毒、抗纤维化等。其中抗病毒对乙肝患者尤为重要。抗病毒治疗（C对）可抑制病毒复制，减轻肝组织病变，改善肝功能，提高生活质量，延缓肝硬化、肝衰竭等的发生，延长存活时间，故符合适应症者应尽可能进行抗病毒治疗，免疫调节治疗（A错）、保肝治疗（B错）、中医中药治疗（D错）、抗纤维化治疗（E错）也作为肝炎治疗，但最重要的是抗病毒病因治疗。